平滑面早期龋临床特点是
A. 呈白垩色点或斑，一般无主观症状，有一定的好发部位
B. 呈白垩色点或斑，遇冷、热刺激时可出现疼痛
C. 呈白垩色点或斑，可出现在牙齿的任何部位
D. 呈白垩色点或斑，探诊硬而光滑，病变呈对称性
E. 浅龋洞形成，遭受外界刺激时可有反应

正确答案：A。呈白垩色点或斑，一般无主观症状，有一定的好发部位

解析：本题考查平滑面早期龋的临床特点。浅龋可分为窝沟龋和平滑面龋，平滑面早期龋位于釉质内，一般呈白垩色点或斑，因龋损较浅，患者一般无主观症状，有一定的好发部位（A对），遭遇外界的刺激如冷、热、酸、甜刺激时亦无明显反应（BE错），探诊时有粗糙感或能钩住探针尖端。釉质呈白垩色点或斑，可出现在牙齿的任何部位为釉质钙化不全的临床表现（C错）。釉质呈白垩色，探诊时局部硬而光滑，病变常呈对称性为釉质发育不全的临床表现（D错）。